男，32岁。发热、头痛伴呕吐2天，意识障碍半天，于8月20日来诊。查体：T39.6℃，P130次/分，R23次/分，BP125/70mmHg，浅昏迷，皮肤未见瘀点，颈抵抗（+），Kernig征（+），Babinski征（+）。实验室检查：血WBC16.0×10⁹/L，N0.73，L0.27。目前迫切需要采取的措施是
A. 静脉点滴抗生素
B. 物理降温
C. 快速静脉点滴甘露醇
D. 静脉高营养
E. 快速镇静

正确答案：C。快速静脉点滴甘露醇

解析：中年男性，发热、头痛伴呕吐2天，意识障碍半天（流行性乙型脑炎初期症状），于8月20日入院（流行性乙型脑炎夏秋季高发）。查体T39.6℃，P130次/分，R23次/分，BP125/70mmHg。浅昏迷，皮肤未见瘀点，颈抵抗（+），Kernig征（+），Babinski征（+）。（流行性乙型脑炎极期症状）。实验室检查血WBC16.0×10⁹/L（正常参考值4～10×10⁹/L），中性粒细胞0.73（正常参考值0.5～0.7），淋巴细胞0.27（正常参考值值0.2～0.4）。根据患者临床表现及实验室检查，该患者最可能的诊断为流行性乙型脑炎，临床上以高热、意识障碍、抽搐、病理反射及脑膜刺激征为特征，目前尚无特效的抗病毒治疗药物，重点在于处理好高热、抽搐、控制脑水肿和呼吸衰竭等危重症状，患者目前发热、头痛伴呕吐，合并颈抵抗（+），Kernig征（+），Babinski征（+）（脑膜刺激征），提示颅内压升高，需快速减低颅内压，应快速静脉点滴甘露醇（C对）。流行性乙型脑炎是由乙型脑炎病毒感染所致，静脉点滴抗生素（A错）无效，而且可能加重脑水肿。流行性乙型脑炎引起的高热，可予以物理降温（B错），静脉高营养（D错）为一般治疗措施，但都不是目前迫切需要采取的措施。对于因脑实质病变引起的抽搐，可使用镇静剂，患者目前未出现抽搐症状，无需预防性使用镇静剂（E错）。